左心衰竭的临床表现是
A. 肺循环淤血伴有心输出量不足
B. 心输出量相对不足
C. 体循环静脉淤血
D. 肺循环淤血伴有体循环静脉淤血
E. 体循环静脉淤血伴有心输出量不足

正确答案：A。肺循环淤血伴有心输出量不足

解析：冠心病、高血压病等疾病致左心衰竭时，左心室泵血功能减退，导致左心输出量不足。心输出量不足导致心室收缩后滞留于内的血液增多，心室舒张期充盈压升高，肺循环血液回流受阻，造成肺循环淤血（A对）。同理可知右心衰竭导致右心输出量不足，右心室充盈压升高，体循环血液回流受阻，造成体循环静脉淤血（E错）。肺循环淤血伴有体循环静脉淤血（D错）是全心衰的表现。